白天，山坡表面因日照而增温，气温比谷地高，因此，山坡空气上升，形成
A. 山风
B. 谷风
C. 海风
D. 陆风
E. 城市热岛

正确答案：B。谷风

解析：本题考查谷风。白天，山坡表面因日照而增温，气温比谷地高，因此，山坡空气上升，形成谷风（B对ACDE错）。